原发性肝癌转移最主要的部位是
A. 肺
B. 骨
C. 肝内
D. 腹腔内种植
E. 左锁骨上淋巴结

正确答案：C。肝内

解析：肝癌在其发展过程中，极易侵犯门静脉分支，形成门静脉癌栓，引起肝内播散，其最主要的转移部位是肝内（C对）。肺（A错）、骨（B错）是肝外血性转移最常见的部位。腹腔内种植（D错）、左锁骨上淋巴结（E错）均较少见。